以下药物中需检查的特殊杂质是:维生素C
A. 有关物质
B. 其他甾体
C. 硒
D. 铁和铜
E. 生育酚

正确答案：D。铁和铜